儿科常见病种发病率最高的是
A. 消化系统疾病
B. 循环系统疾病
C. 呼吸系统疾病
D. 营养性疾病
E. 泌尿系统疾病

正确答案：C。呼吸系统疾病

解析：一般来说，儿科常见病种发病率最高的是呼吸系统疾病（C对）。消化系统疾病（A错）位列第二。循环系统疾病（B错）、营养性疾病（D错）和泌尿系统疾病（E错）发病率均不高。